依据检验目的不同，药品检验可分为不同的类别。关于药品检验的说法中正确的有
A. 委托检验系药品生产企业委托具有相应检测能力并通过资质认定或认可的检验机构对本企业无法完成的检验项目进行检验
B. 抽查检验系国家依法对生产、经营和使用的药品按照国家药品标准进行抽查检验
C. 出厂检验系药品检验机构对药品生产企业要放行出厂的产品进行的质量检验
D. 复合检验系对抽验结果有异议时，由药品检验仲裁机构对异议的药品进行再次抽验
E. 进口药品检验系对于未获得《进口药品注册证》或批件的进口药品进行的检验

正确答案：A、B、C、D。委托检验系药品生产企业委托具有相应检测能力并通过资质认定或认可的检验机构对本企业无法完成的检验项目进行检验；抽查检验系国家依法对生产、经营和使用的药品按照国家药品标准进行抽查检验；出厂检验系药品检验机构对药品生产企业要放行出厂的产品进行的质量检验；复合检验系对抽验结果有异议时，由药品检验仲裁机构对异议的药品进行再次抽验

解析：本题考查药品检验的类别。药品检验所通过药品的检验与检查的手段进行质量监督。根据其目的和处理方法不同，分为抽查性检验、委托检验、复核检验、技术仲裁检验及进出口检验等类型。1.委托检验系药品生产企业委托具有相应检测能力并通过资质认定或认可的检验机构对本企业无法完成的检验项目进行检验（A对）。2.抽查检验系国家依法对生产、经营和使用的药品按照国家药品标准进行抽查检验（B对）。3.出厂检验系指药品检验机构对药品生产企业要放行出厂的产品进行的质量检验（C对）。4.复合检验系对抽验结果有异议时，由药品检验仲裁机构对异议的药品进行再次抽验（D对）。复核检验亦包括对药品注册标准的审核检验。5.进口药品检验是指对于已经获得《进口药品注册证》或批件的进口药品，进行的检验（E错）。